产生HCG的主要部位是
A. 胎膜
B. 卵巢黄体
C. 合体滋养层细胞
D. 叶状绒毛膜
E. 胎儿胎盘单位

正确答案：C。合体滋养层细胞

解析：胎儿胎盘单位是由胎儿、胎盘及母体共同构成的功能单位。胎盘（P32）由羊膜、底蜕膜和叶状绒毛膜组成，叶状绒毛膜（P32）由合体滋养细胞和胚外中胚层组成。产生HCG（人绒毛膜促性腺激素）的主要部位是合体滋养细胞（C对），选项胎儿胎盘单位（E错）和叶状绒毛膜（D错）在范围上太广，不是最佳答案。胎膜（P35）（A错）的功能为：转运溶质和水，参与羊水平衡的维持；能合成血管活性肽、生长因子和细胞因子；维持羊膜腔的完整性，对胎儿起到保护作用。卵巢黄体（B错）的功能为分泌雌激素、孕激素。